女，58岁，因呼吸困难、胸痛就诊。查体血压120/90mmHg，胸骨右缘第二肋间闻及收缩期喷射样杂音，病理特点为
A. 主动脉瓣缩窄及粘连
B. 主动脉瓣增厚及卷曲
C. 三尖瓣增厚及卷曲
D. 肺动脉瓣缩窄和粘连
E. 肺动脉瓣增厚和卷曲

正确答案：A。主动脉瓣缩窄及粘连

解析：中年女性患者，呼吸困难、胸痛就诊。查体血压120/90mmHg，胸骨右缘第二肋间闻及收缩期喷射样杂音（主动脉狭窄的典型杂音），故患者诊断为主动脉狭窄，其病理特点为主动脉瓣缩窄及粘连（A对）。主动脉瓣增厚及卷曲一般可见于主动脉瓣狭窄或关闭不全（B错）。三尖瓣增厚及卷曲一般可见于三尖瓣狭窄或关闭不全（C错）。肺动脉瓣缩窄和粘连一般可见于肺动脉瓣狭窄（D错）。肺动脉瓣增厚和卷曲一般可见于肺动脉瓣狭窄或关闭不全（E错）。